椎内静脉丛位于
A. 硬膜下隙
B. 硬膜外隙
C. 蛛网膜下隙
D. 椎间孔
E. 软膜下隙

正确答案：B。硬膜外隙

解析：椎内静脉丛位于椎骨骨膜和硬脊膜之间即硬膜外隙（B对），收集椎骨、脊膜、脊髓以及椎体和附近肌肉的静脉血。